婴幼儿腹泻湿热泄泻证的治法是
A. 消食导滞，和中止泻
B. 疏风散寒，理气化湿
C. 清热利湿，清肠止泻
D. 健脾益气，升提助运
E. 补脾温肾，固涩止泻

正确答案：C。清热利湿，清肠止泻

解析：婴幼儿腹泻湿热泻证，是由湿热之邪困遏脾阳，运化失职所致，治以清肠解毒，化湿止泻，方药为葛根黄芩黄连汤，根据最佳选项的原则，选项清热利湿，清肠止泻更接近教材表述（C对）。消食导滞，和中止泻（A错）属于伤食泻的治法。疏风散寒，理气化湿（B错）属于风寒泻的治法。健脾益气，升提助运（D错）属于脾虚泻的治法。补脾温肾，固涩止泻（E错）属于脾肾阳虚泻的治法。